对于我国1岁的婴儿，导致伤害的首位原因是
A. 溺水
B. 自杀
C. 跌倒
D. 交通事故
E. 非故意的机械性窒息

正确答案：E。非故意的机械性窒息